血瘀证特有的面色是
A. 面色萎黄
B. 面色青黑
C. 面色青黄
D. 面色淡白
E. 面色黧黑

正确答案：E。面色黧黑

解析：瘀血证的特征为面色黧黑，由于血行瘀滞，肌肤失养，则血色变紫、变黑，故出现面色黧黑的症状（E对）。面色萎黄，多属脾胃气虚，气血不足（A错）。面色青黑多属阴寒内盛、疼痛剧烈（B错）。面色青黄多属肝郁脾虚、血瘀水停（C错）。面色淡白多属气血不足，或见于失血患者（D错）。